急性肾衰竭（损伤）高钾血症选择血液透析，血钾浓度的下限是
A. 6.0mmol/L
B. 7.5mmol/L
C. 5.5mmol/L
D. 6.5mmol/L
E. 7.0mmol/L

正确答案：D。6.5mmol/L

解析：急性肾衰竭时，肾脏代谢能力丧失，排钾减少，血钾升高，易引发心律失常等疾病，所以当血钾升高时应积极纠正。当血钾＞5.5mmol/L，可以静脉输注10%葡萄糖酸钙（以钙离子对抗钾离子对心脏的毒性作用）、5%碳酸氢钠、葡萄糖加胰岛素（使钾离子进入细胞内而降低血钾），而当血钾＞6.5mmol/L时，应紧急实施血液净化治疗，即选择血液透析的血钾下限为6.5mmol/L（D对）。